生态学研究属于
A. 流行病学的观察法
B. 流行病学的实验法
C. 流行病学的理论与方法学研究
D. 统计分析法
E. 基础实验法

正确答案：A。流行病学的观察法

解析：本题考查生态学研究的分类。生态学研究又称相关性研究，是描述性研究的一种，而描述性研究属于观察法（A对BCDE错）。因此，生态学研究属于流行病学中的观察法。